在五输穴中，经气所行为
A. 井
B. 荥
C. 输
D. 经
E. 合

正确答案：D。经

解析：“经”，意为水流宽大流畅；经穴多位于腕、踝关节以上之前臂、胫部，其经气盛大流行，即所行为经（D对）。井穴（A错）分布在指或趾末端，为经气初出之处；荥穴（B错）分布于掌指或跖趾关节之前，为经气开始流动之处；输穴（C错）分布于掌指或面趾关节之后，其经气渐盛；合穴（E错）位于肘膝关节附近，其经气充盛且入合于脏腑，即所说的“”所出为井，所溜为荥，所注为输，所行为经，所入为合“”。